关于肠道杆菌叙述不正确的是
A. 其中大多数是肠道的正常菌群
B. 中等大小的革兰阴性杆菌
C. 无芽胞，多数为周鞭毛
D. 需氧或兼性厌氧菌
E. 硝酸盐还原试验阴性

正确答案：E。硝酸盐还原试验阴性